患者，男性，40岁，慢性肾炎合并胆囊炎宜用
A. 四环素
B. 头孢唑啉
C. 多西环素
D. 庆大霉素
E. 多黏菌素

正确答案：C。多西环素